每张中成药处方可以开具的药品种类最多是
A. 5种
B. 7种
C. 3种
D. 6种
E. 2种

正确答案：A。5种

解析：根据2007年卫生部《处方管理办法》规定，每次开处方，开具西药，中成药处方，每一种药品应当另起一行，每张处方最多5种（A对）药品。